宜用温水浸泡，不宜直接服用或者口含的剂型
A. 泡腾片
B. 咀嚼片
C. 含漱剂
D. 缓释片
E. 控释片

正确答案：A。泡腾片

解析：本题考查各种剂型的正确使用。泡腾片（A对）一般宜用100～150ml凉开水或温水浸泡，严禁直接服用或口含。咀嚼片（B错）在口腔内的咀嚼时间宜充分，咀嚼后可用少量温开水送服。含漱剂（C错）多为水溶液，含漱后不宜马上饮水和进食，以保持口腔内药物浓度。服用缓、控释制剂的药片（DE错）或胶囊除另有规定外，一般应整片或整丸吞服，严禁嚼碎和击碎分次服用。